以下哪些与盐酸甲氯芬酯性质相符
A. 在弱酸性时较稳定
B. 极易溶于水
C. 在弱碱条件下相对稳定
D. 易被水解
E. 与盐酸羟胺作用后，加FeCl₃呈紫堇色

正确答案：B、D、E。极易溶于水；易被水解；与盐酸羟胺作用后，加FeCl₃呈紫堇色